重组IFN-a对毛细胞白血病的疗效显著此方法属于
A. 治疗用抗原
B. 抗毒素血清
C. 治疗用细胞因子
D. 治疗用可溶性细胞因子受体
E. 治疗用非特异性免疫增强剂

正确答案：C。治疗用细胞因子

解析：治疗用细胞因子：重组IFN-a对毛细胞白血病的疗效显著，对病毒性肝炎、带状疱疹等也有一定疗效。IFN-β可延缓多发性硬化症进展。GM-CSF可治疗化疗后的粒细胞减少症；EPO对肾性贫血疗效显著；IL-11用于肿瘤或化疗所致血小板减少症等。掌握“免疫预防及免疫治疗”知识点。